升麻与薄荷具有的共同功效是
A. 透疹
B. 行气
C. 解毒
D. 升阳
E. 化湿

正确答案：A。透疹

解析：薄荷和升麻的共同功效是透疹（A对）。 薄荷具有行气的功效而升麻不具有此功效（B错）。升麻具有解毒的功效而薄荷不具有此功效（C错）。升麻具有升阳的功效而薄荷不具有（D错）。薄荷和升麻都不具有化湿的功效（E错）二者均能辛散发表，透发麻疹，治疗麻疹初起。